止于肱骨大结节嵴的肌是
A. 胸大肌
B. 胸小肌
C. 背阔肌
D. 小圆肌
E. 大圆肌

正确答案：A。胸大肌

解析：胸大肌（A对）止于肱骨大结节嵴。胸小肌（B错）止于肩胛骨喙突。背阔肌（C错）和大圆肌（E错）止于肱骨小结节嵴。小圆肌（D错）止于肱骨大结节。